社区卫生服务的中心、单位、范围、导向分别是
A. 健康，人，家庭，需求
B. 健康，家庭，社区，需求
C. 健康，人，家庭，需要
D. 疾病，人，社区，需求
E. 疾病，人，社区，需要

正确答案：B。健康，家庭，社区，需求